根据心身疾病的定义，以下不属于心身疾病的是
A. 原发性高血压
B. 腹股沟斜疝
C. 神经性皮炎
D. 消化性溃疡
E. 支气管哮喘

正确答案：B。腹股沟斜疝

解析：心身疾病（P122）指心理社会因素在疾病的发生、发展过程中起重要作用的躯体器质性疾病和躯体功能性障碍，心身疾病的分类包括心血管系统、呼吸系统、消化系统、皮肤系统、肌肉骨骼系统、泌尿系统、内分泌系统、神经系统、生殖系统、外科、儿科、眼科、耳鼻喉科、口腔科的心身疾病和恶性肿瘤。1.心血管系统的心身疾病包括冠状动脉粥样硬化性心脏病、阵发性心动过速、心律不齐、原发性高血压（A对）、原发性低血压、雷诺病等；2.呼吸系统疾病的心身疾病包括支气管哮喘（E对）、过度换气综合征、神经性咳嗽等；3.消化系统的心身疾病包括胃、十二指肠溃疡（D对）、神经性厌食、神经性呕吐、溃疡性结肠炎、肠道易激综合征等；4.皮肤系统的心身疾病包括神经性皮炎（C对）、癌痒症、斑秃、银屑病、多汗症、慢性荨麻疹、湿疹等。腹股沟斜疝（B错，为本题正确答案）不属于心身疾病范畴。